男性，48岁，右上15、14缺失，16近中倾斜约20°，余留牙健康。16～13为基牙固定义齿修复时，应考虑
A. 采用复合固定桥
B. 设计活动连接体
C. 设计单端固定桥
D. 增加基牙数目
E. 加强固位力

正确答案：B。设计活动连接体

解析：本题考查固定桥的组成和分类。本病例为单个缺隙，不能设计复合固定桥。由于16近中倾斜度较大，固定桥修复的难点是难以取得16～13的共同就位道。正确的方法是固定桥的一端设计活动连接体（B对）来解决共同就位道的问题。而设计单端固定桥虽可避免共同就位道的问题，但不利于基牙的健康。16～13基牙牙周膜面积显著大于缺失牙，固定桥不需要增加基牙。